既润肠通便，又兼补虚的药是
A. 薏苡仁
B. 火麻仁
C. 郁李仁
D. 番泻叶
E. 巴豆霜

正确答案：B。火麻仁

解析：本题考查的是火麻仁的性能特点。既润肠通便，又兼补虚的药是火麻仁（B对）。火麻仁：【性能特点】本品甘平油润，香美可口，入脾、大肠经。善润燥滑肠兼补虚，体虚肠燥者最宜。薏苡仁（A错）：【性能特点】本品甘淡渗利兼补，微寒能清，入脾、胃、肺经，利水而不伤正、健脾而不滋腻。生用甘淡微寒，渗利清补，既能清利湿热、除痹排脓，又略兼健脾，湿热或又兼脾虚者宜用。炒用性平，甘淡渗利而兼补，健脾渗湿止泻，脾虚湿盛无热或热不盛者宜用。生用长于利湿、除痹、清热、排脓；炒用长于健脾止泻。郁李仁（C错）：【性能特点】本品辛散苦降，甘平质润，入脾与大肠、小肠经。既润肠通便，又利水消肿，还行肠中滞气。治肠燥便秘，兼气滞者尤佳；治水肿胀满及脚气浮肿，兼二便不利者最宜。番泻叶（D错）：【性能特点】本品苦寒清泄沉降，味甘质黏滑润，入大肠经。大量用（＞3g）既泻热通便，导水湿热毒外出，又行水而退水肿；少量用（＜3g）则助消化、消食积。功似大黄，泻热通肠力亦强，长于滑润大肠，具验、廉、便、简、味不苦易服等优点。巴豆霜（E错）为巴豆的炮制品。巴豆：【性能特点】本品辛热泻散，大毒峻猛。内服入胃经与大肠经，善峻下寒积、逐水退肿；入肺经，善祛痰利咽而治白喉，有斩关夺门之功。外用腐蚀力强而善蚀肉腐疮，喷撒于咽部而能除白喉伪膜，敷于恶疮而能溃脓、去腐肉。生用力猛，虽峻下寒积，但因毒大，故临床几乎不用；熟用毒稍缓而药力强，临床少用；去油制霜即巴豆霜，药力较缓，毒性大减，故临床常用。